下列关于房室结的描述何者正确
A. 是心脏正常节律活动的起搏点
B. 位于冠状窦口的后方
C. 位于Koch三角的心内膜下
D. 位于下腔静脉口的右侧
E. 位于上腔静脉与右心耳交界处的心外膜深面

正确答案：C。位于Koch三角的心内膜下

解析：位于Koch三角的心内膜下（C对）为房室结，其尖对着膜性室间隔的房室部。